口腔健康调查方法之一是
A. 访问调查
B. 随机调查
C. 抽样调查
D. 定点调查
E. 入户调查

正确答案：C。抽样调查

解析：本题考查口腔健康调查的方法。口腔健康调查方法之一是抽样调查（C对）。口腔健康调查方法有普查、抽样调查、捷径调查三种。访问调查（A错）、随机调查（B错）是抽样调查中抽样的方法。定点调查（D错）会导致结果偏倚，不适用于口腔健康调查，一般用于市场调研。入户调查（E错）是普查（也称全面调查）的方法。